对某水样“三氮”检测结果显示，氨氮显著升高，亚硝酸盐氮显著升高，而硝酸盐氮不高，这说明水体
A. 新近受到严重的有机性污染，过去受污染不明显，自净过程正在进行
B. 过去受到污染，自净过程已完成，最近又受到新的有机性污染
C. 从过去某个时期起，水体一直受到严重的有机性污染
D. 过去受到严重的有机性污染，自净过程已经完成
E. 过去受有机性污染不明显，现在受有机性污染非常严重

正确答案：C。从过去某个时期起，水体一直受到严重的有机性污染

解析：本题考查水体受污染情况。由于水样中氨氮显著升高，亚硝酸盐氮显著升高，而硝酸盐氮不高，这表明水体受到了严重的有机性污染，但这种污染不一定是最近才发生的，即从过去某个时期起，水体一直受到严重的有机性污染（C对ABDE错）。